卵巢的形态
A. 前缘游离，后缘附有系膜
B. 内侧端名子宫端
C. 外侧端名输卵管端
D. 性成熟期卵巢最大
E. 后缘中央有一裂隙，称为卵巢门

正确答案：D。性成熟期卵巢最大

解析：卵巢的形态在性成熟期最大（D对），卵巢前缘有卵巢系膜固定，后缘游离（A错），上端称为输卵管端（C错），下端称为子宫端（B错），前缘中部有血管、神经等出入，称为卵巢门（E错）。